女，60岁，绝经7年、阴道淋漓流血19天，高血压史5年，糖尿病病史8年，G1P0，妇科检查：外阴阴道无异常，宫颈光滑，子宫正常大小，双侧附件区无异常，超声示子宫内膜0.8cm，回声不均匀，内膜血流较丰富。最可能的诊断是
A. 卵巢癌
B. 子宫内膜癌
C. 宫颈癌
D. 子宫内膜息肉
E. 老年性阴道炎

正确答案：B。子宫内膜癌

解析：患者绝经后妇女，阴道淋漓流血（提示出血量不规则而量少），超声检查子宫内膜回声不均匀，血流较丰富。结合患者年龄、临床表现及影像学检查，最可能的诊断是子宫内膜癌（B对）。宫颈癌（C错）主要表现为接触性流血，虽与子宫内膜癌均可阴道不规则流血，但具体不同，前者出血量多，后者出血量少，淋漓不尽（P301）。子宫内膜息肉（D错）大多数表现为经间期出血、月经过多、经期延长、或不规则出血，该老年患者已绝经，可排除（P340）。老年性阴道炎（E错）多为萎缩性阴道炎，系绝经后雌激素水平下降 ，局部抵抗力下降所致。主要表现外阴灼热不适、痛痒，阴道分泌物稀薄，呈淡黄色；检查时见阴道皱襞消失、萎缩，散在出血（P245）。